升药的功效是
A. 拔毒去腐
B. 软坚散结
C. 清热解毒
D. 开窍醒神
E. 化痰散结

正确答案：A。拔毒去腐

解析：本题考查的是升药的功效。升药的功效是拔毒去腐（A对）。升药：【功效】拔毒去腐。鳖甲：【功效】滋阴潜阳，退热除蒸，软坚散结（B错）。硼砂：【功效】外用清热解毒（C错），内服清肺化痰。蟾酥：【功效】解毒消肿，止痛，开窍醒神（D错）。猫爪草：【功效】化痰散结（E错），解毒消肿。